神经官能症的特点是
A. 有人格基础
B. 有相应的器质性病变
C. 没有精神病性症状
D. 不能适应社会
E. 有头疼和失眠

正确答案：A。有人格基础

解析：神经症又名神经官能症，是一组精神障碍的总称，几乎可以发生在任何一种精神疾病和一些躯体疾病中，包括神经衰弱、强迫症、焦虑症、恐怖症、躯体形式障碍等等。神经症的共同特点：（1）症状没有相应的器质性病变为基础（B错）；（2）起病常与心理社会因素有关；（3）社会现实检验能力未受损害，社会功能相对完好（D错）；（4）一般没有明显或持续的精神病性症状（C错）；（5）病前有一定的人格基础（A对）；（6）一般自知力完整，有求治要求；（7）特异性较差。